对重症抑郁症患者，尤其要注意的是
A. 防兴奋伤人毁物
B. 防自伤
C. 防藏药
D. 防外逸
E. 防过食

正确答案：B。防自伤